以下哪项指由病原生物引起的所有人类疾病
A. 传染病
B. 免疫
C. 保健
D. 炎症
E. 感染性疾病

正确答案：E。感染性疾病

解析：传染病是指由特异病原体（或它们的毒性产物）所引起的一类疾病：这种病原体及其毒性产物可以通过感染的人、动物或储存宿主直接或间接方式（经由中介的动物宿主、昆虫、植物宿主或其他环境因素）传染给易感宿主。而感染性疾病是指由病原生物引起的所有人类疾病。因此，感染性疾病的概念要比传染病的概念更宽泛。掌握“传染病预防及控制”知识点。